某蛋白分子具有以下特点：①为三聚体（α、β、γ）；②有激活型和抑制型两种；③αGTP为其活化形式；④具有潜在的GTP酶活性。该蛋白最有可能
A. 属于CAM
B. 属于胰岛素受体
C. 属于PKA
D. 活化后调节AC活性
E. 活化后调节PKC活性

正确答案：D。活化后调节AC活性